为防止片剂的崩解迟缓，制备时宜选用的润滑剂为
A. A辅料（接触角=36℃）
B. B辅料（接触角=91℃）
C. C辅料（接触角=98℃）
D. D辅料（接触角=104℃）
E. E辅料（接触角=121℃）

正确答案：A。A辅料（接触角=36℃）

解析：本题考查影响片剂崩解的因素。水分透入是崩解的首要条件。根据毛细管理论，当接触角θ大于90°，水分不能透入到片剂的孔隙中，片剂不能被水润湿，较难崩解。若需要崩解顺利，需要润滑剂有较小的接触角，接触角小于90°利于崩解（A对）。